男，55岁，被重物砸伤双下肢2小时。查体：P108次/分，BP113/64mmHg，神志清楚，双肺呼吸音清未闻及干湿性啰音，心律齐，腹软，无压痛，双下肢肿胀，广泛软组织挫裂伤，最佳处理方法是
A. 快速输平衡盐溶液
B. 输血
C. 使用升压药
D. 输葡萄糖溶液
E. 输血浆代用品

正确答案：A。快速输平衡盐溶液

解析：患者被重物砸伤双下肢2小时后，双下肢肿胀，广泛软组织挫裂伤，这时应警惕患者可能存在发生挤压综合征（挤压综合征是指人体四肢或躯干等肌肉丰富的部位遭受重物长时间的挤压，在挤压解除后出现身体一系列的病理生理改变。临床上主要表现为：肢体肿胀、肌红蛋白尿、高血钾症及高血钾为特点的急性肾功能衰竭、酸中毒及氮质血症等症状）的风险。因本症的死亡率较高，所以预防是关键。对于挤压伤的治疗除了及早解除重物压力、伤肢制动、开放伤口和活动性出血者应止血外，还应伤后尽快补充乳酸林格氏液和胶体液（或者平衡盐溶液）（A对）、碱化尿液、利尿等。输血（B错）、使用升压药（C错）、及输血浆代用品（E错）主要用于发生休克的患者，而该患者血压为113/64mmHg（正常血压正常值90～120/60～80mmHg），未发生休克，故应排除。输葡萄糖（D错）主要用于发生低血糖及高血钾的患者，而该患者未有低血糖及高血钾的临床表现，故应排除。